环境卫生学的重点研究内容是
A. 环境因素的调查与监测
B. 污染物在环境中的分布与转归
C. 环境污染治理
D. 环境因素的健康效应
E. 环境质量评价

正确答案：D。环境因素的健康效应

解析：本题考查环境卫生学的研究内容。环境卫生学的主要研究内容有：1.环境与健康关系的基础理论研究（D对ABCE错）：这是解决环境与健康问题的基石，是环境卫生学的前沿领域；2.环境因素与健康关系的确认性研究；3.创建和引进适宜于环境卫生学研究的新技术和新方法；4.研究环境卫生监督体系的理论依据。